青霉素抗菌作用的机制是
A. 干扰细菌细胞壁的合成
B. 干扰细菌细胞蛋白质的合成
C. 破坏细菌细胞膜通透性
D. 破坏细菌细胞核酸的代谢
E. 干扰细菌胞质颗粒的形成

正确答案：A。干扰细菌细胞壁的合成